高甜度蔗糖代用品是
A. 甜叶菊糖
B. 赤藓糖醇
C. 木糖醇
D. 果糖

正确答案：A。甜叶菊糖

解析：本题考查糖代用品。高甜度蔗糖代用品是甜叶菊糖（A对）。蔗糖代用品有两类：一类为高甜度代用品：如天冬苯丙二肽酯、苯甲酸亚胺、环拉酸盐、甜叶菊糖，这些糖比蔗糖甜20～400倍，有抑菌作用。另一类为低甜度代用品，如木糖醇（C错）、山梨醇、甘露醇、麦芽糖、异麦芽酮糖醇等。赤藓糖醇（B错）可以限制变异链球菌生长，是一种可以减少龋病的食用糖醇。果糖（D错）能渗入牙菌斑生物膜，被细菌直接利用产酸，合成细胞壁多糖、荚膜多糖，但合成能力低于蔗糖。